已知某地女性“0～”岁组的尚存人数为100000，WHO提出的终寿区间成数α＝0.09，死亡人数为675人，则“0～”岁组的生存人年数为
A. 99325
B. 99386
C. 99235
D. 99337
E. 100000

正确答案：B。99386

解析：本题考查生存人年数的计算。根据公式（17-5），将题中数据代入，“0～”岁组的生存人年数＝（100000－675）＋0.09×675≈99386（B对ACDE错）。